学龄前儿童膳食蛋白质中来源于动物性的蛋白质应占到
A. 0.5
B. 0.33333333333333
C. 0.25
D. 0.2
E. 0.16666666666667

正确答案：A。0.5

解析：本题考查学龄前儿童膳食蛋白质中来源于动物性蛋白质的比例。学龄前儿童蛋白质的RNI为20～25g/d，其中动物性蛋白质应占到1/2（A对BCDE错）。